孕妇，37岁。G₂P₁，2年前顺产1男婴，确诊为21-三体综合征，本次自然受孕，现孕16周，咨询唐氏筛查事宜，对其合理的建议为
A. 行孕早期，孕中期联合唐氏筛查
B. 20～24周B超筛查有无唐氏儿可能
C. 羊膜腔穿刺性染色体检查
D. 行孕早期唐氏筛查
E. 行孕中期唐氏筛查

正确答案：C。羊膜腔穿刺性染色体检查

解析：青年孕妇，G2P1（孕2产1），2年前顺产1男婴，确诊为21–三体综合征（不良生育史），现孕16周，再次妊娠发生染色体畸形的风险很高。此时需要做产前诊断，羊膜腔穿刺性染色体检查（C对）。20~24周B超主要用于筛查胎儿结构畸形（B错）。唐氏筛查对染色体疾病高危孕妇的检查意义不大（DE错）。